患者，男，28岁，游泳后回到家中，发现眼睛出现瘙痒、异物感，并有黄色黏液性分泌物，该患者适宜选用药物是
A. 左氧氟沙星滴眼液
B. 毛果芸香碱滴眼液
C. 玻璃酸钠滴眼液
D. 色甘酸钠滴眼液
E. 阿昔洛韦滴眼液

正确答案：A。左氧氟沙星滴眼液

解析：本题考查左氧氟沙星滴眼液。患者出现瘙痒、异物感、并有黄色分泌物可考虑为细菌感染引起的急性结膜炎，可选用抗菌药物进行治疗。左氧氟沙星滴眼液（A对）可用于治疗由细菌所致的结膜炎。毛果芸香碱滴眼液（B错）可用于治疗青光眼。使用人工泪液（玻璃酸钠滴眼液（C错）、羟甲基纤维素钠滴眼液、聚乙醇滴眼液等）可改善眼部干燥症状。醋酸可的松、醋酸氢化可的松或色甘酸钠滴眼液（D错）和眼膏用于过敏性结膜炎。阿昔洛韦滴眼液（E错）用于单纯疱疹性角膜炎。